C-3位含有酸性较强的杂环，可通过血脑屏障，用于脑部感染治疗的药物是
A. 头孢氨苄
B. 头孢克洛
C. 头孢呋辛
D. 硫酸头孢匹罗
E. 头孢曲松

正确答案：E。头孢曲松

解析：本题考查头孢菌素类抗菌药。头孢曲松（E对）的C-3位上引入酸性较强的杂环，可以通过血脑屏障，用于脑部感染治疗。头孢氨苄（A错）的C-3位乙酰氧甲基换成甲基，可在酸性条件下稳定。头孢克洛（B错）C-3位甲取代为氯原子。头孢呋辛（C错）的C-3位取代为氨基甲酸酯。头孢匹罗（D错）含季铵基团。